属于年轻恒牙牙髓特点的有
A. 防御修复反应强，增生现象显著
B. 组织疏松，血运丰富
C. 渗透作用强
D. A和B
E. A、B、C三项

正确答案：D。A和B

解析：本题考查年轻恒牙牙髓的特点。年轻恒牙血管丰富，生活力旺盛，因此其防御修复反应强，增生现象显著（A对），有利于控制感染和消除炎症。这也是临床上活髓保存疗法的有利条件。牙髓组织疏松，血运丰富（B对），感染也极易扩散。（AB对，故D为本题的正确答案）。渗透作用强（CE错）为年轻恒牙牙釉质的特点。